子宫动脉在距子宫颈外侧约2cm处
A. 横过输卵管的前方
B. 与输尿管并行
C. 横过输尿管的后下方
D. 横过输尿管的前上方
E. 行于子宫阔韧带前方

正确答案：D。横过输尿管的前上方

解析：子宫动脉在距子宫颈外侧约2cm处横过输尿管的前上方（D对），发出分支营养子宫、卵巢、输卵管和阴道，并与卵巢动脉吻合。